关于个体给药方案调整的方法，错误的是
A. 可通过监测患者血药浓度调整给药剂量
B. 可通过患者肌肝清除率调整给药剂量
C. 可根据患者体重、体表面积及年龄调整给药剂量
D. 可根据药物分布速率常数调整给药剂量
E. 可结合患者用药后的临床表现调整给药剂量

正确答案：C。可根据患者体重、体表面积及年龄调整给药剂量

解析：本题考查个体给药方案调整。给药方案个体化的步骤根据诊断结果及患者的身体状况等具体因素，选择适合的药物及给药途径，再拟定初始给药方案。按初始方案用药后，随时观察临床效果并按一定时间采取血样标本，测定血药浓度，由血药浓度-时间数据，求出患者的药动学参数。根据患者的临床表现、药动学数据，结合临床经验和文献资料对初始给药方案做必要的修改，制订出调整后给药方案，用于患者疾病的治疗。根据患者的临床表现、药动学数据，结合临床经验和文献资料对初始给药方案做必要的修改，制订出调整后给药方案（E错，为本题正确答案）。